存在关节唇的关节
A. 肩关节
B. 肘关节
C. 腕关节
D. 膝关节
E. 踝关节

正确答案：A。肩关节

解析：肩关节存在关节唇，加深关节窝（A对）。